依据中药五味学说，具有软坚散结、泻下通便作用的是
A. 甘味药
B. 苦味药
C. 咸味药
D. 辛味药
E. 酸味药

正确答案：C。咸味药

解析：本题考查咸味药的临床应用。咸能软、能下，有软坚散结、泻下通便作用，如治瘰疬、痰核的昆布、海藻，治癥瘕的鳖甲，治热结便秘的芒硝等，均具咸味。故食盐类咸味药（C对）不宜多食，高血压动脉硬化者尤当如此。有的咸味药如芒硝，能泻下通肠，脾虚便溏者慎用。甘能补、能缓、能和，有补虚、和中、缓急、调和药性等作用。如治虚证的黄芪、熟地、核桃仁、枸杞子，治挛急作痛、调和药性的饴糖、甘草等，均具甘味。某些甘味药（A错）还能解药、食毒，如甘草、蜂蜜等。此外，甘味药多质润而善于滋燥。甘味药大多能腻膈碍胃，令人中满，凡湿阻、食积、中满气滞者慎用。苦能泄、能燥、能坚。苦味药（B错）大多能伤津、伐胃，津液大伤及脾胃虚弱者不宜大量用。辛能散、能行，有发散、行气、活血作用。如治表证的荆芥、薄荷，治气滞的香附，治血瘀的川芎等，都具有辛味。辛味药（D错）大多能耗气伤阴，气虚阴亏者慎用。酸能收、能涩，有收敛固涩作用。如治自汗盗汗、遗精滑精的五味子，治久泻久痢的五倍子，治久咳的乌梅，治大汗虚脱、崩漏经多的山茱萸等，均具酸味。另外，酸能生津、安蛔，如木瓜、乌梅等。酸味药（E错）大多能收敛邪气，凡邪未尽之证均当慎用。